某小学校160名学生，在饭店定做课间餐，学生在当天上午8:50～9:00食用，大约3小时后，其中有79人出现头晕、腹痛、腹泻、恶心、呕吐。腹泻主要是黄绿色水样便，每日数次至10余次。腹痛多在上腹部，伴有压痛，体温一般在38～40℃。根据血清分型对人类致病的菌型常见的为哪几型
A. C～E型
B. A～D型
C. B～D型
D. A～E型
E. D～E型

正确答案：D。A～E型